下列进出盆腔的神经，哪一条不经过梨状肌下孔
A. 臀上神经
B. 臀下神经
C. 坐骨神经
D. 股后皮神经
E. 阴部神经

正确答案：A。臀上神经

解析：臀上神经（A错，为本题正确选项）伴臀上血管经梨状肌上孔出盆腔至臀部。臀下神经（B对）伴随臀下血管经梨状肌下孔出盆腔至臀部。坐骨神经（C对）经梨状肌下孔出盆腔至臀大肌深面。股后皮神经（D对）与臀下神经相伴穿经梨状肌下孔出盆腔至臀部。阴部神经（E对）伴随阴部血管穿出梨状肌下孔至臀部。